超抗原（S-Ag）是
A. 能非特异激活多克隆B细胞并能刺激其分泌大量细胞因子的抗原
B. 能特异激活多克隆T细胞并能刺激其分泌大量细胞因子的抗原
C. 能特异激活多克隆B细胞并能刺激其分泌大量细胞因子的抗原
D. 能非特异激活多克隆T细胞并能刺激其分泌大量细胞因子的抗原
E. 能非特异激活多克隆T细胞并能刺激其分泌大量适应因子的抗原

正确答案：D。能非特异激活多克隆T细胞并能刺激其分泌大量细胞因子的抗原

解析：本题考查抗原基本概念、分类、超抗原及佐剂。超抗原（S-Ag）是能非特异激活多克隆T细胞并能刺激其分泌大量细胞因子的抗原（D对）。